事物或现象阴阳属性的征兆是
A. 寒热
B. 上下
C. 水火
D. 晦明
E. 动静

正确答案：C。水火

解析：本题是对经典原文的考查。《素问·阴阳应象大论》说：“天地者，万物之上下也；阴阳者，血气之男女也；左右者，阴阳之道路也；水火者，阴阳之征兆也（C对）；金木者，生成之终始也。气有多少，形有盛衰，上下相召，而损益彰矣。”“水火者，阴阳之征兆也” 以水火而言，水为阴，火为阳，因为水性寒而润下属阴，火性热而炎上属阳 也就是说水和火很能代表阴和阳的含义。